治疗胃炎寒邪客胃证，应首选
A. 化肝煎
B. 良附丸
C. 保和丸
D. 失笑散
E. 益胃汤

正确答案：B。良附丸

解析：胃炎寒邪客胃证治宜温胃散寒，理气止痛，应首选行气疏肝，散寒止痛的良附丸治疗（B对）。化肝煎功用疏肝泄热和胃，主治怒气伤肝，气逆动火，胁痛胀满，烦热动血（A错）。保和丸消食导滞，适用于脘满不食，嗳腐吐食的胃痛证（C错）。失笑散活血化瘀，通络止痛适用于胃痛淤血停胃证（D错）。益胃汤功用养阴益胃，适用于胃阴不足证（E错）。